下列疔疮，容易损筋伤骨的是
A. 烂疔
B. 红丝疔
C. 颜面疔
D. 疫疔
E. 手足疔

正确答案：E。手足疔

解析：疔是一种发病迅速，易于变化而危险性较大的急性化脓性疾病。多发于颜面何手足等处。其特点是疮形虽小，但脚跟坚硬，有如钉丁之状，病情变化迅速，容易造成毒邪走散。发于颜面部的疔疮很容易走黄而有生命危险。发生于手足部的疔疮则易损筋伤骨而影响功能。而且烂疔、红丝疔、颜面疔、疫疔均易发生传变而造成走黄，手足疔则易损伤筋骨（E对）。